甲状腺功能亢进合并哮喘的患者慎用的药物是
A. 异丙托溴铵
B. 沙美特罗
C. 茶碱
D. 奥马珠单抗（抗IgE抗体）
E. 孟鲁司特

正确答案：C。茶碱

解析：本题考查哮喘药物。茶碱（C对）对发热、妊娠、小儿或老年人，患有肝、心、肾功能障碍及甲状腺功能亢进者须慎用。异丙托溴铵（A错）与β₂受体激动剂联合应用，适用于夜间哮喘及痰多的患者。沙美特罗（B错）属长效β₂受体激动剂（LABA），不能单独用于哮喘的治疗，与糖皮质激素联合使用是目前常用的哮喘控制方案。奥马珠单抗（抗IgE抗体）（D错）主要用于吸入型糖皮质激素和LABA联合治疗后症状仍未控制且血清IgE水平增高的重症哮喘患者。孟鲁司特（E错）与沙丁胺醇联合使用用于阿司匹林所致哮喘。